根据情志相胜法，可制约大怒的情志是
A. 喜
B. 思
C. 悲
D. 恐
E. 惊

正确答案：C。悲

解析：情志生于五脏，五脏之间有着生克关系，所以情志之间也存在着生克关系。运用情志相互制约的关系来达到调中情志治疗疾病的目的便是情志病治疗中的情志相胜法。即一“行”的情志可以制约其“所胜”的情志。怒为肝志，属木；喜为心志，属火，思为脾志，属土；悲为肺志，属金；恐为肾志，属水。火能克金，故喜能胜悲（A错）。土能克水，故思能胜恐（B错）。金能克木，故悲能胜怒（C对）。水能克火，故恐能胜喜（D错）。惊与肾的关系密切，不能制约大怒（E错）。